下列诊断支气管哮喘的依据，错误的是
A. 有反复发作喘息的病史
B. 发作时有吸气性呼吸困难
C. 肺部弥漫性哮鸣音
D. 支气管扩张药治疗有效
E. 必要时进行支气管扩张试验

正确答案：B。发作时有吸气性呼吸困难

解析：支气管哮喘简称哮喘，是由多种细胞和细胞组分参与的气道慢性炎症性疾病，临床多表现为反复发作的喘息（A对）、气急、咳嗽、胸闷等症状，多数患者可自行缓解或经治疗后缓解。典型症状为发作性伴有啸鸣音的呼气性呼吸困难（B错，为本题正确答案），典型体征为发作时双肺可闻及广泛啸鸣音（C对）。诊断时进行支气管扩张试验（E对）检查可测定气道可逆性改变，试验阳性提示存在可逆性的气道阻塞。治疗时使用支气管扩张剂（D对）如白三烯调节剂，在抗炎的同时可发挥舒张支气管平滑肌的作用，可作为轻度哮喘的替代治疗药物和中、重度哮喘的联合治疗药物。